患者小便点滴不通，烦渴欲饮，咽干咳嗽，舌苔薄黄，脉数。其治法是
A. 行瘀散结，通利水道
B. 疏调气机，通利小便
C. 清泄肺热，通利水道
D. 清热利湿，通利小便
E. 升清降浊，化气利水

正确答案：C。清泄肺热，通利水道

解析：肺热壅盛，失于肃降，不能通调水道，下输膀胱，故小便不畅，点滴不爽；肺热上壅，故烦渴欲饮，呼吸急促；舌红苔薄白，脉数，为肺热壅盛之征；治疗应清泄肺热，通利水道（C对）。行瘀散结，通利水道（A错）常用于治疗尿路阻塞证。疏调气机，通利小便（B错）可以用于治疗肝郁气滞证。清热利湿，通利小便（D错）可以用于治疗膀胱湿热证。升清降浊，化气利水（E错）可用于治疗中气下陷证。